以下哪项是突发公共卫生事件的特点
A. 社会性
B. 传播性
C. 特异性
D. 频发性
E. 非常规性

正确答案：E。非常规性

解析：突发公共卫生事件其特点有：①突发性；②普遍性；③非常规性。掌握“突发公共卫生事件”知识点。